一定时期内，一定范围人群中某病新病例发生的频率
A. 发病率
B. 死亡率
C. 罹患率
D. 病死率
E. 患病率

正确答案：A。发病率